器官移植患者应用免疫抑制剂环孢素，同时服用利福平会使机体出现排斥反应的原因是
A. 利福平与环孢素竞争与血浆蛋白结合
B. 利福平的药酶诱导作用加快环孢素的代谢
C. 利福平改变了环孢素的体内组织分布量
D. 利福平与环孢素竞争肾小管分泌机制
E. 利福平增加胃肠运动，使环孢素排泄加快

正确答案：B。利福平的药酶诱导作用加快环孢素的代谢

解析：本题考查利福平的药酶诱导作用。利福平属于肝药酶诱导剂，有肝药酶诱导作用，能加速环孢素代谢（B对）使药效减弱，器官移植患者应用免疫抑制剂环孢素，同时服用利福平便会出现排斥反应。器官移植患者应用免疫抑制剂环孢素，同时服用利福平会使机体出现排斥反应的原因与与环孢素竞争与血浆蛋白结合（A错）、改变了环孢素的体内组织分布量（C错）、与环孢素竞争肾小管分泌机制（D错）、增加胃肠运动，使环孢素排泄加快（E错）无关。